尘肺分期的诊断主要依靠
A. 临床症状
B. 肺通气量
C. 生化指标检测
D. X线胸片

正确答案：D。X线胸片

解析：本题考查尘肺分期的依据。要根据可靠的生产性粉尘接触史、现场劳动卫生学调查资料，以技术质量合格的X线高仟伏或数字化摄影（DR）后前位胸片表现作为主要依据，结合工作场所职业卫生学、尘肺流行病学调查资料和职业健康监护资料，参考临床表现和实验室检查，排除其他肺部类似疾病后，对照尘肺诊断标准片作出尘肺病的诊断和X线分期。劳动者临床表现和X线胸片（D对ABC错）检查符合尘肺病的特征，在没有证据否定其与接触粉尘之间存在必然联系的情况下，可由有诊断资质的诊断组诊断为尘肺病。